1984年7月1日至14日，某单位职工中发生一次菌痢爆发流行，病例分布有两个高峰，一个峰在7月3日，一个峰在7月14日后无明显余波，这次爆发最可能是
A. 点源流行
B. 连续传播
C. 同源一次暴露
D. 重复暴露的同源流行
E. 是由食物污染引起的

正确答案：D。重复暴露的同源流行

解析：本题考查持续同源传播的特点。持续同源传播是持续暴露于同一传染源而导致疾病的暴发，与点源暴露类似，流行曲线快速上升，达到发病高峰后，出现一个平台期；如果消除传染源，则曲线快速下降，如果传染源自然损耗，则曲线呈缓慢下降。题中描述的疾病暴发特点符合重复暴露的同源流行（D对ABCE错）。